女，48岁。近1个月来出现口渴。每日饮水量约2000ml。身高156cm，体重70kg。患者空腹血糖180mg/dL(10.0mmol/L），餐后血糖252mg/dL(14.0mmol/L），过去无糖尿病病史。【假设信息】治疗3个月后，空腹血糖99mg/dL(5.5mmol/L），餐后血糖225mg/dL(12.5mmol/L），治疗改为
A. 使用胰岛素
B. 格列齐特
C. 阿卡波糖
D. 那格列奈
E. 二甲双胍

正确答案：C。阿卡波糖

解析：患者女，48岁。近1个月来出现口渴。身高156cm，体重70kg。患者空腹血糖180mg/dL(10.0mmol/L），餐后血糖252mg/dL(14.0mmol/L），过去无糖尿病病史，诊断为2型糖尿病，患者治疗3个月后，空腹血糖99mg/dL(5.5mmol/L），餐后血糖225mg/dL(12.5mmol/L），该患者空腹血糖控制良好，餐后血糖明显升高，进一步的治疗应改为α-葡萄糖苷酶抑制剂，即阿卡波糖（C对）。